尼可刹米中有关物质的检查方法是
A. 比色法
B. 薄层色谱法
C. 比浊法
D. 紫外分光光度法
E. 旋光度法

正确答案：B。薄层色谱法